佝偻病初期长骨X线表现为
A. 骨骺软骨明显增宽
B. 干骺端临时钙化带模糊
C. 骨质普遍稀疏
D. 有明显变化
E. 骨干弯曲

正确答案：B。干骺端临时钙化带模糊

解析：初期（早期）血钙正常或稍低，血磷低，钙磷乘积稍低（30～40），血清25-（OH）D3下降，碱性磷酸酶正常或增高。此期无骨骼改变，X线片检查多正常，或仅见临时钙化带模糊。掌握“维生素D缺乏性佝偻病”知识点。